关于目的和目标的阐述，正确的是
A. 目的和目标是一回事，只是提法不同罢了
B. 目的是量化的、具体化的目标
C. 目标是量化的、具体化的目的
D. 目的必须具有可操作性，可以准确进行测量
E. 目的和目标都是量化的

正确答案：C。目标是量化的、具体化的目的